属于生物地球化学性疾病的是
A. 黑脚病，痛痛病
B. 水俣病，地方性氟中毒
C. 黑脚病，碘缺乏病
D. 心血管病，黑脚病
E. 痛痛病，地方性氟中毒

正确答案：C。黑脚病，碘缺乏病

解析：本题考查生物地球化学性疾病。生物地球化学性疾病是由于地壳表面化学元素分布的不均匀性，使某些地区的水和（或）土壤中某些元素过多或过少，当地居民通过饮水、食物等途径摄入这些元素过多或过少，而引起某些特异性疾病。主要包括：碘缺乏病、地方性氟中毒、地方性砷中毒、乌脚病等（C对）。痛痛病（AE错）是发生在日本富山县神通川流域部分镉污染地区的一种严重的环境污染性疾病，以全身剧烈疼痛为主要症状而得名，是慢性镉中毒的典型案例。水俣病（B错）是因食入被有机汞污染河水中的鱼、贝类所引起的甲基汞为主的有机汞中毒或是孕妇吃了被有机汞污染的海产品后引起婴儿患先天性水俣病，是有机汞侵入脑神经细胞而引起的一种综合性疾病。心血管病（D错）一般指心脑血管疾病，泛指由于高脂血症、血液黏稠、动脉粥样硬化、高血压等所导致的心脏、大脑及全身组织发生的缺血性或出血性疾病。